因含马兜铃酸而被国家药品监督管理部门取消药品标准的中药有
A. 黄芩
B. 葛根
C. 关木通
D. 青木香
E. 广防己

正确答案：C、D、E。关木通；青木香；广防己

解析：本题考查中药的主要化学成分。因含马兜铃酸而被国家药品监督管理部门取消药品标准的中药有关木通（C对）、青木香（D对）、广防己（E对）。目前，国家药品监督管理部门已经下文取消了关木通、广防己、青木香3味含马兜铃酸的中药药用标准。从黄芩（A错）中分离出来的黄酮类化合物有黄芩苷（含4.0%～5.2%）、黄芩素、汉黄芩苷、汉黄芩素等。其中黄芩苷是主要有效成分。葛根（B错）中的主要成分：葛根含异黄酮类化合物，主要成分有大豆素、大豆苷、大豆素-7，4’-二葡萄糖苷及葛根素、葛根素-7-木糖苷。